口服缓释制剂可采用的制备方法有
A. 增大水溶性药物的粒径
B. 与高分子化合物生成难溶性盐
C. 包衣
D. 微囊化
E. 将药物包藏于溶蚀性骨架中

正确答案：B、C、D、E。与高分子化合物生成难溶性盐；包衣；微囊化；将药物包藏于溶蚀性骨架中

解析：本题考查缓（控）释制剂。缓释、控释制剂的释药原理包括溶出原理、扩散原理、溶蚀与扩散结合的原理、渗透压原理、离子交换作用。根据不同释药原理，可采取不同方法制备缓释制剂：（1）溶出原理：制成溶解度小的盐或酯、制成药物-高分子化合物难溶性盐（B对）、控制粒子大小（A错）。（2）扩散原理：包衣（C对）、微囊化（D对）、制成不溶性的骨架片、制成植入剂、制成经皮吸收制剂、增加黏度以减小扩散速度。（3）溶蚀与扩散结合的原理：将药物包藏于溶蚀性骨架中（E对）。